产后小便不通的发病机理是
A. 膀胱气化失司
B. 脾肺气虚，不能通调水道
C. 肾阳不振，气化失司
D. 气机阻滞，清浊升降失常
E. 膀胱失约

正确答案：A。膀胱气化失司

解析：产后小便不通的主要病机是膀胱气化失司。尿液的正常排出，有赖于膀胱的气化，而膀胱的气化功能，又与肺、脾、肾三脏密切相关，因肺主气，通调水道，下输膀胱脾主运化，转输水液;肾主水，司二便，与膀胱互为表里，若肺脾气虚，肾阳不足，或瘀血阻滞，可导致膀胱气化失常，发为小便不通（A对）。